内侧丘系传递
A. 痛觉信息
B. 温度觉信息
C. 触觉信息
D. 听觉信息
E. 本体感觉信息和精细触觉

正确答案：E。本体感觉信息和精细触觉

解析：内侧丘系参与躯干和四肢意识性本体感觉和精细触觉（E对）传导通路，该传导路由3级神经元组成，第2级神经元发出的轴突交叉部位在延髓水平,而后行于延髓中线两侧，称内侧丘系。